下列符合恶性高血压特征性病理变化是
A. 肾入球小动脉玻璃样变
B. 肾细动脉壁纤维素样坏死
C. 肾动脉粥瘤
D. 肾小球毛细血管内透明血栓
E. 肾小球纤维化

正确答案：B。肾细动脉壁纤维素样坏死

解析：恶性高血压的特征性病变是增生性小动脉硬化和坏死性细动脉炎，多累及于肾脏，主要表现为肾细动脉壁纤维素样坏死（B对）。肾入球小动脉玻璃样变（A错）是良性高血压（P140）的特征性病理变化。肾动脉粥瘤（C错）可形成于肾动脉粥样硬化较严重时。肾小球毛细血管内透明血栓（D错）为DIC（弥散性血管内凝血）的病理变化。肾小球纤维化（E错）为各种肾小球损伤发展到终末阶段的病理变化（P273）。